在制备44（牙合）面洞时，洞底应
A. 与龈缘平行
B. 与长轴垂直
C. 与（牙合）面平行
D. 与牙的颊面垂直

正确答案：C。与（牙合）面平行

解析：本题考查Ⅰ类洞预备要点。44（牙合）面洞属Ⅰ类洞，髓腔顶的形态与（牙合）面形态一致，因此在预备窝洞时，洞底时应与（牙合）面平行（C对），以防穿髓。在制备44（牙合）面洞时若洞底与龈缘平行（A错）、与长轴垂直（B错）、与牙的颊面垂直（D错）时洞底与髓腔顶不平行，均有可能穿髓。